需血浆置换的疾病是
A. 急性肾炎
B. ANCA相关性血管炎伴肺出血
C. 急性肾小管坏死
D. 急性间质性肾炎
E. Ⅲ型狼疮性肾炎

正确答案：B。ANCA相关性血管炎伴肺出血

解析：血浆置换是应用血浆置换机分离患者的血浆和血细胞，弃去血浆，以等量正常人的血浆（或血浆白蛋白）和患者血细胞重新输入体内，重复多次，直到血清抗体（如抗GBM抗体、ANCA）转阴或病情好转。ANCA相关性血管炎伴肺出血（B对）是由于体内大量抗GBM（肾小球基底膜）抗体及ANCA（抗中性粒细胞胞质抗体）同时作用于肾脏和肺，导致急进性新月体型肾小球肾炎和肺出血，需要紧急治疗，血浆置换可以迅速清除体内的血清抗体，缓解病情进展。急性肾炎（A错）一般以卧床休息，对症治疗以及抗感染治疗为主，少数发生急性肾衰竭时采用透析治疗（P467）；急性肾小管坏死（C错）一般以尽早纠正可逆病因、维持内环境稳定、营养支持、防治并发症及肾脏替代治疗为主（P516）；急性间质性肾炎（D错）一般以停用肾损害药物、免疫抑制治疗、血液透析治疗为主（P488）；Ⅲ型狼疮性肾炎（E错）肾脏病变较轻，可不治疗或采用激素及细胞毒性药物进行治疗（P482），以上疾病均不需血浆置换治疗。